男，45岁。近半年来总是莫名的紧张担忧，凡事总往坏处想。该患者最可能的诊断是
A. 急性焦虑发作
B. 广泛性焦虑症
C. 恐怖症
D. 急性应激障碍
E. 强迫障碍

正确答案：B。广泛性焦虑症

解析：该患者近半年来总是莫名的紧张担忧（常常有不明原因的紧张不安），以焦虑为主要表现，最可能的诊断是广泛性焦虑症（B对）。急性焦虑发作（惊恐发作）的患者常突然发作、强烈的惊恐体验伴濒死感（A错）。恐惧症和广泛性焦虑障碍都以焦虑为核心症状，但恐惧症的焦虑由特定的对象或处境引起，呈境遇性和发作性，而焦虑障碍的焦虑常没有明确的对象，常持续存在（C错）。